流行性乙型脑炎最常见和最早出现的症状是
A. 腹泻
B. 呕吐
C. 食欲不振
D. 发热
E. 头痛

正确答案：E。头痛

解析：头痛是乙脑最常见和最早出现的症状，疼痛部位不定（E对）。